确定矽肺病分期哪项不是必需的依据
A. 职业史
B. 肺部X线变化
C. 临床症状
D. 现场调查资料

正确答案：C。临床症状

解析：本题考查尘肺分期的必需参考依据。根据详细可靠的职业史（A对），由具有尘肺病理诊断资质的病理专业人员按照《尘肺病病理诊断标准》（GBZ25-2014）提出尘肺的病理诊断报告，病人历次X线胸片（B对）、病例摘要或死亡日志及现场劳动卫生学资料（D对）是诊断的必需参考条件。临床症状可以对哦安短疾病有所帮助，但存在误导性，不能作为尘肺分期的必需依据（C错，为本题正确答案）。